极易霉变的环境温湿度是
A. 温度20℃～35℃湿度75%以上
B. 温度20℃～35℃湿度75%以下
C. 温度10℃～20℃湿度75%以上
D. 温度10℃～20℃湿度75%以下
E. 温度10℃～20℃湿度60%以下

正确答案：A。温度20℃～35℃湿度75%以上

解析：本题考查的是中药饮片贮存中常见的质量变异现象。极易霉变的环境温湿度是温度20℃～35℃湿度75%以上（A对）。霉变：是指饮片受潮后在适宜温度条件下，引发寄生在其表面或内部的霉菌大量繁殖，导致发霉的现象。霉变对饮片的危害仅次于虫蛀。我国地处温带，特别是长江以南地区，夏季炎热、潮湿，饮片最易发霉。霉变饮片不能再供药用。当霉菌在潮湿的环境下，遇到适宜的温度（20～35℃），即可萌发菌丝，并分泌酵素，侵蚀饮片组织内部，使其腐烂变质、气味走失，而且有效成分也遭到很大的破坏，以致不能药用。凡含有糖类、黏液质、淀粉、蛋白质及油类的饮片较易霉变，如牛膝、天冬、马齿苋、菊花、蕲蛇、五味子、人参、独活、紫菀等。此外中药鲜药因含水量较多，也容易发生霉变。湿度是指空气中含有水蒸气量的程度，也就是空气潮湿的程度。它是影响药物质量的一个极重要因素，不仅可引起药物的物理和化学变化，如含水量、外观形态、化学成分发生改变等，而且能影响微生物的繁殖及害虫的生长。一般炮制品的绝对含水量应控制在7%～13%，贮存环境的相对湿度应控制在35%～75%。当空气相对湿度达到75%，温度30℃，很多饮片会加速吸收空气中的水分，而使本身含水量增加，易发生霉变现象，特别是含糖类、黏液质、淀粉类饮片更容易吸潮变质，如天冬、地黄、山药等；一些粉末状药物也易吸潮粘连成块。相对湿度高于75%时，多数无机盐类矿物药都容易潮解，如芒硝、胆矾；盐炙的饮片也容易吸收空气中的水分而变潮，继而生霉，如盐知母等；有些蜜炙饮片，如炙甘草、炙黄芪、炙枇杷叶等，特别容易吸湿粘连，吸湿后饮片表面也容易霉变。但当相对湿度过低时，饮片的含水量又易逐渐降低，含结晶水的药物易失去结晶水而风化。